关于胆囊结石描述，错误的是
A. 胆囊结石均有症状
B. 进食油腻食物后症状加重
C. 大的单发结石不易发生嵌顿
D. 结石嵌顿于胆囊壶腹后，导致急性胆囊炎
E. 胆绞痛向右肩部放射

正确答案：A。胆囊结石均有症状

解析：大多数胆囊结石患者可无症状（A错，为本题正确答案）。胆囊结石典型症状为胆绞痛，进食油腻食物后，由于胆囊收缩和迷走神经兴奋，症状加重（B对）。胆囊颈直径约0.2～0.4cm，因此大的结石不容易嵌顿于胆囊管（C对）。结石嵌顿在胆囊壶腹部后，结石直接损伤黏膜，胆汁排除受阻，滞留、浓缩，高浓度胆汁酸盐具有细胞毒性，引起细胞损害，导致急性胆囊炎（D对）。胆绞痛可向右肩部放射（E对）。